破伤风应用玉真散的目的是
A. 疏风解表，解毒镇痉
B. 清热解毒利湿
C. 清除毒素
D. 活血化瘀通络
E. 祛风化痰镇痉

正确答案：E。祛风化痰镇痉

解析：中医学认为破伤风先有破伤，而后风邪由创口侵入而发生。创伤后或溃疡尚未愈合，若失于调护，流血过多，饮食未复，机体营卫虚弱，风邪乘虚袭入人体，由外入里而发生病变。风邪入里传肝，引动肝风，肝失条达，表现四肢抽搐、角弓反张、牙关紧闭等肝风内动症状。故需用玉真散祛风化痰，定搐镇痉（E对）。